属于临界瘤的是
A. 牙龈瘤
B. 血管瘤
C. 脂肪瘤
D. 淋巴管瘤
E. 成釉细胞瘤

正确答案：E。成釉细胞瘤

解析：本题考查临界瘤。临界瘤是既有向良性肿瘤缓慢生长的趋势、也有向恶性肿瘤侵袭性生长的处于良恶性之间的肿瘤。成釉细胞瘤（E对）生长缓慢，初期出现自觉症状，肿瘤侵犯牙槽突时，可使牙松动、移位或脱落，具有一定的侵袭性。牙龈瘤（A错）属于瘤样病变，血管瘤（B错）、脂肪瘤（C错）、淋巴管瘤（D错）属于良性肿瘤，不易恶变。